女，33岁。健康查体时ECG发现偶发房性期前收缩。既往体健。查体：心界不大，心率80次/分，心脏各瓣膜区未闻及杂音。该患者最恰当的处理措施是
A. 寻找病因，定期随诊
B. 口服普罗帕酮
C. 口服慢心律
D. 口服胺碘酮
E. 静脉注射利多卡因

正确答案：A。寻找病因，定期随诊

解析：患者青年女性，既往体健，偶发房性期前收缩，未见临床症状，查体正常，所以该患者最恰当的处理措施是寻找病因，定期随诊（A对）。当房性期前收缩患者有明显症状或因房性期前收缩触发室上性心动过速时，应给予治疗。治疗药物可选用普罗帕酮（B错）、胺碘酮（D错）、莫雷西嗪或β受体拮抗剂。本例患者并无临床症状，无需药物治疗。慢心律即美西律（P206）（C错），属于ⅠB类抗心律失常药，常用于急、慢性室性快速性心律失常，小儿先天性心脏病与室性心律失常等。利多卡因（九版药理学P196）（E错）主要治疗室性心律失常，如心脏手术、心导管术、急性心肌梗死或强心苷中毒所致的室性心动过速或心室纤颤。